女，30岁。腹痛伴低热、腹泻便秘交替1个月。查体：右下腹压痛，可触及边界不清的包块，活动度差。对明确诊断最有意义的检查是
A. 腹部CT
B. B超引导下腹部包块穿刺
C. 结肠X线钡剂造影
D. 腹腔血管造影
E. 结肠镜

正确答案：E。结肠镜

解析：青年女性，腹痛伴低热（结核毒血症表现）、腹泻便秘交替1个月。查体：右下腹压痛（肠结核常见表现），可触及边界不清的包块（可见于增生型肠结核），活动度差。综合患者病史、症状、查体，应考虑增生型肠结核可能性大。但也不排除克罗恩病可能，为明确诊断应行结肠镜（E对），若内镜下见回盲部等处充血、水肿，溃疡形成，炎症息肉，肠腔变窄。病灶处活检，发现肉芽肿、干酪样坏死或抗酸杆菌时，可以确诊为肠结核。腹部CT（A错）、B超引导下腹部包块穿刺（B错）（B超引导下穿刺多适用于出现腹水的患者，可协助诊断，不宜直接进行包块的穿刺）、结肠X线钡剂造影（C错）、腹腔血管造影（D错）有一定的诊断价值，但结肠镜对肠结核最具确诊价值。